四神丸的组成药物中含有
A. 草豆蔻
B. 白豆蔻
C. 肉豆蔻
D. 砂仁
E. 厚朴

正确答案：C。肉豆蔻

解析：本题考查四神丸的药物组成。四神丸为固涩剂，由肉豆蔻(煨)、补骨脂(盐炒)、五味子(醋制)、吴茱萸(制)、大枣(去核)组成（C对）。趣记：四神将枣子肉喂鱼，治五更泻。―四神姜枣脂肉味萸，治五更泻。